Pa02取决于
A. 血氧容量
B. 吸入气的氧分压和外呼吸功能
C. 血红蛋白的质和量
D. 血氧饱和度
E. 血氧含量

正确答案：B。吸入气的氧分压和外呼吸功能

解析：肺的外呼吸包括肺通气和肺换气两个过程，肺通气是指肺与外界环境之间的气体交换过程；肺换气则为肺泡与肺毛细血管血液之间的气体交换过程。而动脉血压分压（Pa02）的高低主要取决于吸入气的氧分压和外呼吸功能（B对）。